硫酸链霉素中链霉糖特有的鉴别反应是
A. 坂口反应
B. 茚三酮反应
C. 羟肟酸铁反应
D. 硫色素反应
E. 麦芽酚反应

正确答案：E。麦芽酚反应